属于终动脉的是
A. 上颌动脉
B. 脑膜中动脉
C. 直肠上动脉
D. 视网膜中央动脉
E. 颈浅动脉

正确答案：D。视网膜中央动脉

解析：视网膜中央动脉（D对）属于终动脉，与相邻动脉之间无吻合。